腓深神经支配
A. 腘肌
B. 腓骨长肌
C. 腓肠肌
D. 胫骨前肌
E. 胫骨后肌

正确答案：D。胫骨前肌

解析：腘肌（A错）、腓肠肌（C错）和胫骨后肌（E错）由胫神经支配。腓骨长肌（B错）腓浅神经支配。腓深神经支配胫骨前肌（D对）、拇长伸肌和趾长伸肌。